影响人群易感性降低的主要因素有
A. 预防接种
B. 易感人口的迁入
C. 免疫人口的死亡
D. 新生儿在人群比例的增加
E. 免疫人口免疫力的自然消退

正确答案：A。预防接种